创伤性休克早期最常出现的酸碱失衡类型是
A. 呼吸性碱中毒
B. 代谢性碱中毒
C. 代谢性酸中毒
D. 呼吸性酸中毒
E. 代谢性酸中毒合并呼吸性碱中毒

正确答案：A。呼吸性碱中毒

解析：休克的本质是氧供给不足和需求增加，休克早期，机体通过过度换气进行代偿，发生呼吸性碱中毒（A对）。当休克进一步加重可出现呼吸困难，氧释放不能满足细胞对氧的需要时，将发生无氧糖酵解，丙酮酸及乳酸大量产生，最终引起代谢性酸中毒（C错）。代谢性碱中毒（B错）常见于胃液丧失过多、碱性物质摄入过多、缺钾。呼吸性酸中毒（D错）常见于麻醉过深、镇静剂使用过量、中枢神经系统损伤、气胸等。代谢性酸中毒合并呼吸性碱中毒（E错）常见于脓毒症患者，一方面严重的感染影响组织灌流，造成组织缺氧，产生乳酸积聚，导致代谢性酸中毒；另一方面感染等因素导致过度通气从而发生呼吸性碱中毒。此题为有争议题目，有的辅导书认为创伤性休克属于低血容量性休克的一种，组织灌注不足导致缺血缺氧，可使丙酮酸及乳酸大量产生，发生代谢性酸中毒。